一位诊断为慢性牙周炎的45岁男性患者，其治疗方案为先应进行基础治疗，下列做法中哪一项是错误的
A. 口腔卫生宣教
B. 洁治和根面平整
C. 拔除无保留价值的患牙
D. 咬合创伤的牙可先调（牙合）
E. 必要时可全身应用抗生素

正确答案：D。咬合创伤的牙可先调（牙合）

解析：本题考查牙周病治疗程序的第一阶段-基础治疗。一位诊断为慢性牙周炎的45岁男性患者，其治疗方案为先应进行基础治疗，下列做法中错误的是咬合创伤的牙可先调（牙合）（D错，为本题正确答案）。第一阶段-基础治疗：1.教育并指导患者自我控制菌斑的方法（A对），如建立正确的刷牙方法和习惯，使用牙线、牙签、间隙刷等辅助工具保持口腔卫生等。2.施行洁治术、根面平整术（B对）以消除龈上和龈下菌斑、牙石。3.消除菌斑滞留因素及其他局部刺激因素，如充填龋洞、改正不良修复体、治疗食物嵌塞等，还应做必要的牙髓治疗、纠正口呼吸习惯等。4.拔除无保留价值或预后极差的患牙（C对），对临床病损程度极为严重、或者不利于整体口腔健康而有较大潜在危害、或者不利于整体修复治疗效果长期稳定性的患牙，应在适当时机拔除。5.在炎症控制后进行必要的咬合调整，以建立平衡的咬合关系，必要时可做暂时性的松牙固定。有些牙周炎患牙在炎症消除后，牙齿位置能有轻度的自行调整，故除非很明确且严重的（牙合）创伤，一般的调（牙合）治疗应在炎症消退后进行。6.药物治疗。对于侵袭性牙周炎和某些重度牙周炎患者，在基础治疗时适当使用抗生素能明显改善疗效（E对）。7.发现和尽可能纠正全身性或环境因素，如吸烟、用药情况、全身病的控制等。